冶疗老年性骨质疏松的药物
A. 钙制剂
B. 甲泼尼龙
C. 维生素D
D. 人促红素
E. 双膦酸盐

正确答案：A、C、E。钙制剂；维生素D；双膦酸盐

解析：本题考查骨质疏松症的药物治疗。钙剂（A对）、维生素D（C对）和一种骨吸收抑制剂（以双膦酸盐（E对）尤其是阿仑膦酸钠）的三联药物治疗为目前较为公认的治疗老年性骨质疏松症方案。甲泼尼龙（B错）抗炎作用强，对钠潴留作用微弱，作用同泼尼松。人促红素（D错）适用于肾功能不全所致的贫血，外科围术期的红细胞动员等。